在有感染的肉芽创面上植皮，宜选用
A. 表层皮片
B. 薄中厚皮片
C. 厚中厚皮片
D. 全厚皮片
E. 保存真皮带血管网全厚皮片

正确答案：A。表层皮片

解析：本题考查游离皮片移植。游离皮片移植适用于大面积的浅层组织，包括皮肤和黏膜的缺损。一般说来，有感染的肉芽创面或骨面只能采用表层皮片（A对）移植，因为此种皮片移植后生活力强，抗感染力亦强，容易存活。薄中厚皮片（B错）多应用于口腔内植皮；厚中厚皮片（C错）或全厚皮片（D错）多应用于面颈部植皮；保存真皮带血管网全厚皮片（E错）用于在肌腱或肌暴露处移植。